可用于治疗绦虫感染的药物是
A. 林旦
B. 氯硝柳胺
C. 哌嗪
D. 甲硝唑
E. 环吡酮胺

正确答案：B。氯硝柳胺

解析：本题考查氯硝柳胺。可用于治疗绦虫感染的药物是氯硝柳胺（B对）。驱绦虫药氯硝柳胺能抑制绦虫细胞内线粒体的氧化磷酸化过程，高浓度时可抑制虫体呼吸并阻断对葡萄糖的摄取，从而使之发生变质。林旦（A错）为抗寄生虫药，用于疥疮和阴虱病。哌嗪（C错）主要用于驱蛔虫。甲硝唑（D错）用于治疗肠道和肠外阿米巴病（如阿米巴肝脓肿、胸膜阿米巴病等）；还可用于治疗阴道滴虫病、小袋虫病和皮肤利什曼病、麦地那龙线虫感染等；目前还广泛用于厌氧菌感染的治疗。环吡酮胺（E错）用于浅部皮肤真菌感染，如体、股癣，手、足癣（尤其是角化增厚型），花斑癣，皮肤念珠菌病，也适用于甲癣，也用于脂溢性皮炎。